不仅适用于正态分布，也适用于偏态分布的评价方法是
A. 指数法
B. 离差法
C. 百分位数法
D. 等级评价法
E. 曲线图法

正确答案：C。百分位数法

解析：本题考查体格生长调查的方法。百分位数法（C对ABDE错）不仅在呈现非正态分布时，能更准确地反映出所测数值的分布情况，也可在当变量呈正态分布时，百分位数法与离差法的相应数相当接近。